治疗过敏性结膜炎可选用的药物是
A. 酞丁安滴眼液
B. 色甘酸钠滴眼液
C. 氧氟沙星滴眼液
D. 羟甲基纤维素钠滴眼液
E. 毛果芸香碱滴眼液

正确答案：B。色甘酸钠滴眼液

解析：本题考查结膜炎治疗药。治疗过敏性结膜炎可选用的药物是色甘酸钠滴眼液（B对）。色甘酸钠滴眼液不仅可以抑制炎症过程的早期表现，还能降低毛细血管壁和毛细血管膜的通透性，减少炎症的渗出。酞丁安（A错）可用于治疗流行性结膜炎，也可用于治疗沙眼。氧氟沙星滴眼液（C错）可用于治疗由细菌所致的结膜炎。羟甲基纤维素钠滴眼液（D错）属于人工泪液，可改善眼部干燥症状。毛果芸香碱滴眼液（E错）可用于治疗青光眼。